诊断化妆品痤疮时重点需要了解
A. 痤疮发生的时间
B. 痤疮的类型和部位
C. 化妆品接触史和施用的部位
D. 所施用化妆品的卫生质量
E. 施用化妆品的种类和频率

正确答案：C。化妆品接触史和施用的部位

解析：本题考查化妆品痤疮的诊断。化妆品痤疮是由化妆品引起的面部痤疮样皮疹，诊断化妆品痤疮时重点需要了解化妆品接触史和施用的部位（C对ABDE错）。痤疮的发生多见于经常施用膏霜类化妆品者，由于化妆品堵塞皮脂腺汗腺毛囊口，或在患者皮脂腺分泌旺盛的情况下不当使用，增加毛囊堵塞的机会，皮脂不能顺畅排出，积聚而形成。皮疹表现在接触部位出现与毛孔一致的黑头粉刺、炎性丘疹及脓疱，或在原有痤疮的基础上施用后症状明显加重。